以下药物中杂质的检查方法是，葡萄糖注射液中的5-羟甲基糠醛
A. 紫外分光光度法
B. 热重分析法
C. 薄层色谱法
D. 分子排阻色谱法
E. 气相色谱法

正确答案：A。紫外分光光度法